关于非遗传毒性致癌物的叙述，不正确的是
A. 不具有DNA反应活性
B. 在大多数遗传毒理学试验中为非致突变物
C. 经代谢活化可形成亲电子剂
D. 一般具有可检测的阈剂量
E. 作用一般是可逆的，需长期染毒

正确答案：C。经代谢活化可形成亲电子剂